来源于单子叶植物，须根先端膨大，呈纺锤形的药材是
A. 附子
B. 玄参
C. 泽泻
D. 百部
E. 太子参

正确答案：D。百部

解析：本题考查的是根类中药的不同形态。来源于单子叶植物，须根先端膨大，呈纺锤形的药材是百部（D对）。根的形状，通常为圆柱形、长圆锥形、圆锥形或纺锤形等。双子叶植物的根一般为直根系，主根发达，侧根较细。主根常为圆柱形，如甘草、黄芪、牛膝等；或呈圆锥形，如白芷、黄芩、桔梗等；有的呈纺锤形，如地黄、何首乌等；少数为须根系，多数细长的须根集生于根茎上，如细辛、威灵仙、龙胆等。单子叶植物的根一般为须根系，有的须根先端膨大成纺锤形块根，如百部、郁金、麦冬等。附子（A错）：【性状鉴别】药材呈圆锥形。玄参（B错）：【性状鉴别】药材呈类圆柱形，中部略粗或上粗下细，有的微弯曲。泽泻（C错）：【性状鉴别】药材呈类球形、椭圆形或卵圆形。太子参（E错）：【性状鉴别】药材呈长纺锤形或细长条形，稍弯曲。